性凉，驱杀绦虫宜研粉冲服的药是
A. 雷丸
B. 芦荟
C. 鹤草芽
D. 地肤子
E. 苦楝皮

正确答案：C。鹤草芽

解析：本题考查的是鹤草芽的性味归经、主治病证和用法用量。性凉，驱杀绦虫宜研粉冲服的药是鹤草芽（C对）。鹤草芽：【性味归经】苦、涩、凉。归肝、小肠、大肠经。【主治病证】绦虫病。【用法用量】内服：研粉吞服，成人每次30～50g。小儿按体重0.7～0.8g/kg，每日1次，早晨空腹服。雷丸（A错）：【性味归经】苦，寒。有小毒。归胃、大肠经。【主治病证】（1）绦虫病，钩虫病，蛔虫病。（2）小儿疳积。【用法用量】内服：15～21g，不宜入煎剂，一般研粉或入丸剂，每次5～7g（驱杀绦虫每次12～18g），饭后用温开水调服，每日3次，连服3天。芦荟（B错）：【性味归经】苦，寒。归大肠、肝经。【主治病证】（1）热结便秘，肝经实火，肝热惊风。（2）小儿疳积，虫积腹痛。（3）癣疮（外用）。【用法用量】内服：2～5g，入丸剂，不入汤剂，或研末装入胶囊服。外用：适量，研末干撒，或调敷。地肤子（D错）：【性味归经】甘、苦、辛，寒。归肾、膀胱经。【主治病证】（1）热淋。（2）风疹，湿疹，阴痒，湿疮。【用法用量】内服：煎汤，9～15g；或入丸散。外用：适量，煎汤熏洗，或研末敷。苦楝皮（E错）：【性味归经】苦，寒。有毒。归脾、胃、肝经。【主治病证】（1）蛔虫病，蛲虫病，钩虫病。（2）头癣，疥疮。【用法用量】内服：煎汤，3～6g，鲜品15～30g；或入丸散。外用：适量，研末调敷，或煎汤洗。